下列对感冒的叙述不正确的是
A. 无体质强弱之分
B. 有时行感冒和一般感冒之区别
C. 风邪侵袭人体所致
D. 鼻塞，流涕，喷嚏，头痛，恶寒，发热
E. 全年有发，冬春多见

正确答案：A。无体质强弱之分

解析：体质因素决定个体对某种病邪的易感性，而且六淫病邪或时行之邪侵袭人体能否引起感冒，与卫气强弱和感邪轻重有关，所以患感冒与体质强弱有关（A错，为本题正确答案）。感冒是以鼻塞，流涕，喷嚏，头痛，恶寒，发热，全身不适为主症的病症，是最常见的外感病之一（D对）。四季皆可发病，以冬春季节多见（E对）。在一个时期内广泛流行、病情类似者称为时行感冒（B对）。感冒是因六淫、时行之邪，侵袭肺卫，以致卫表不和，肺失宣肃而为病（C对）。